A型人格最容易患什么病
A. 冠心病
B. 消化道溃疡
C. 癌症
D. 支气管哮喘
E. 荨麻疹

正确答案：A。冠心病

解析：A型行为模式是1950年由美国两位心脏病专家Friedman和Rosenman提出的概念，他们发现CHD病人大都有较高的成就欲望，富于挑战和竞争精神，容易发生无端敌意、争强好胜、不耐烦、有时间紧迫感等，A型行为中的愤怒和敌意在冠心病的发病中具有重要的作用，故答案选择A。癌症（C错）多与C型行为模式相关。